病例对照研究中，最好的对照来自于
A. 家人
B. 邻居
C. 亲属
D. 社区中非该病病人或健康人
E. 医院其他病人

正确答案：D。社区中非该病病人或健康人

解析：本题考查病例对照研究中对照的来源。在病例对照研究中，对照的最佳选择为同一个社区中的非该病病人或健康人（D对ABCE错）。